金铃子散主治的是
A. 肝郁气滞胁痛
B. 肝郁化火胁痛
C. 肝郁血虚胁痛
D. 肝郁阴虚胁痛
E. 肝胆实火胁痛

正确答案：B。肝郁化火胁痛

解析：该题考查金铃子散的主治病证。金铃子散功能疏肝泄热，活血止痛。肝郁气滞胁痛应疏肝理气（A错）。肝郁化火之胁痛应疏肝泄热，活血止痛，为金铃子散的主治病证（B对）。肝郁血虚胁痛应疏肝养血（C错）。肝郁阴虚胁痛应滋阴疏肝（D错）。肝胆实火胁痛应清肝泻火（E错）。